患者，女，孕8周，诊断为“甲状腺功能减退症”，给予左甲状腺素钠片治疗。对该患者的用药指导，错误的是
A. 孕期甲减可能对胎儿造成不良影响，服药期间应监测甲功
B. 服用左甲状腺素钠片期间如出现心悸、多汗或体重下降，应及时就诊
C. 左甲状腺素钠极少通过胎盘，治疗剂量下对胎儿无不良影响
D. 应于早餐后将一日剂量左甲状腺素钠片一次性用温水送服
E. 左甲状腺素钠起效较慢，一般几周后才能达到最佳疗效

正确答案：D。应于早餐后将一日剂量左甲状腺素钠片一次性用温水送服

解析：本题考查甲状腺功能减退症。甲状腺功能减退症治疗以口服甲状腺片或左甲状腺素为主，左甲状腺素成人初始剂量一日25～50㎍，一日1次，随后每隔2周以25㎍调整至适宜剂量，以保证稳定的正常新陈代谢，可能需要一日100～300㎍或较大剂量。左甲状腺激素的吸收易受饮食中的钙、铁等金属离子的影响，应在晨起空腹（D错，为本题正确答案）服用全天的左甲状腺素钠。孕期甲减可能对胎儿造成不良影响，服药期间应监测甲功（A对）。服用左甲状腺素钠片期间如出现心悸、多汗或体重下降，应及时就诊（B对）。左甲状腺素钠极少通过胎盘，治疗剂量下对胎儿无不良影响（C对）。左甲状腺素钠起效较慢，一般几周后才能达到最佳疗效（E对）。